女，7岁，持续发热一周，体温可达39.6～40.2℃，每天最低温度为37.8℃左右，此热型属于
A. 波浪热
B. 间歇热
C. 稽留热
D. 弛张热
E. 不规则热

正确答案：D。弛张热

解析：该患者持续发热一周，体温可达39.6～40.2℃，最高体温与最低体温之差为2.4℃，每天最低温度为37.8℃左右，在正常体温之上（体温常在39℃以上，波动幅度大，24小时内波动范围超过2℃，但都在正常水平以上），此热型属于弛张热（D对）。波浪热（A错）是指体温逐渐上升达39℃或以上，数天后又逐渐降至正常水平，持续数天后又逐渐升高，如此反复多次。间歇热（B错）是指体温骤升达高峰后持续数小时，又迅速降至正常水平，无热期（间歇期）可持续1天到数天，如此高热期与无热期反复交替出现。稽留热（C错）是指体温恒定地维持在39～40℃以上的高水平，达数天或数周，24小时内体温波动范围不超过1℃。不规则热（E错）的发热体温曲线无一定规律。